促进胰岛素分泌的药物是
A. 二甲双胍
B. 罗格列酮
C. 格列齐特
D. 吡格列酮
E. 阿卡波糖

正确答案：C。格列齐特